抽搐不伴有意识障碍最可能的原因是
A. 急性脑血管病
B. 脑外伤
C. 癫痫
D. 癔病
E. 小儿高热惊厥

正确答案：D。癔病

解析：抽搐是指全身或局部成群骨骼肌非自主的抽动或强烈收缩，常可引起关节运动和强直。抽搐不伴有意识障碍最可能的原因是癔病（D对）。急性脑血管病（A错）可出现抽搐伴肢体偏瘫。脑外伤（B错）可出现抽搐伴剧烈头痛。癫痫（C错）可出现抽搐伴瞳孔扩大与舌咬伤。小儿高热惊厥（E错）可出现抽搐伴高热。